颈静脉搏动可见于
A. 二尖瓣关闭不全
B. 主动脉瓣关闭不全
C. 三尖瓣关闭不全
D. 肺动脉瓣关闭不全
E. 甲状腺功能亢进症

正确答案：C。三尖瓣关闭不全

解析：三尖瓣关闭不全（C对）的患者在心室收缩时血液可以自右心室逆流入右心房，引起颈静脉收缩期向上性搏动充盈，可见颈静脉搏动。二尖瓣关闭不全（A错）时心尖部可扪及有力的、局限性、抬举性心尖搏动。主动脉瓣关闭不全（P116）（B错）、甲状腺功能亢进症（P116）（E错）可见颈动脉搏动。肺动脉瓣关闭不全（D错）时胸骨左下缘扪及右心室高动力性收缩期搏动。